界嵴
A. 是左心室流入道和流出道的分界
B. 是右心室流入道和流出道的分界
C. 是腔静脉窦和固有心房的分界
D. 为卵圆窝前上方的嵴
E. 无

正确答案：C。是腔静脉窦和固有心房的分界

解析：左心室流入道和流出道的分界（A错）为二尖瓣前尖。右心室流入道和流出道的分界（B错）为室上嵴。腔静脉窦和固有心房的分界（C对）为界沟以及相对应的界嵴。